哺乳动物细胞中DNA紫外线损伤最主要的修复酶是
A. DNA聚合酶α
B. DNA聚合酶β
C. DNA聚合酶γ
D. DNA聚合酶δ
E. DNA聚合酶ε

正确答案：E。DNA聚合酶ε